慢性肾衰竭最常见并发的电解质及酸碱平衡紊乱是
A. 高钾血症、代谢性酸中毒
B. 低钾血症、代谢性酸中毒
C. 高钾血症、呼吸性酸中毒
D. 低钾血症、呼吸性碱中毒
E. 高钾血症、代谢性碱中毒

正确答案：A。高钾血症、代谢性酸中毒

解析：发生慢性肾衰竭时，肾小管分泌氢离子障碍导致体内氢离子蓄积或肾小管HCO3-重吸收能力受损，HCO3-丢失过多，两种机制均可引起体内H+/HCO3-失衡导致代谢性酸中毒（CDE错），肾功能损伤时肾脏排钾能力下降，引起钾离子体内蓄积导致高钾血症（A对）。